适用于呼吸道给药的速效剂型是
A. 注射剂
B. 舌下片
C. 滴丸（水溶性基质）
D. 涂膜剂
E. 气雾剂

正确答案：E。气雾剂

解析：本题考查剂型按给药途径和给药方法分类。适用于呼吸道给药的速效剂型是气雾剂（E对）。呼吸道给药的剂型：如气雾剂、吸入剂等。经注射给药的剂型如静脉、肌内、皮下、皮内及穴位注射剂（A错）。经黏膜给药的剂型：如滴眼剂、滴鼻剂、口腔膜剂、舌下片（B错）剂、含漱剂等。经口服给药的剂型：如汤剂、合剂、糖浆剂、颗粒剂、丸剂（C错）、片剂等。经皮肤给药的剂型：如洗剂、搽剂、涂膜剂（D错）、糊剂、软膏剂、硬膏剂、贴剂、贴膏剂等。